Ⅱ型超敏反应性疾病是
A. 过敏性休克
B. 溶血
C. 过敏性鼻炎
D. 血清病
E. 荨麻疹

正确答案：B。溶血

解析：本题考查Ⅱ型超敏反应性疾病。属于Ⅱ型超敏反应性疾病是溶血（B对）。过敏性休克（A错）、荨麻疹（E错）属于Ⅰ型超敏反应。过敏性鼻炎（C错）属于Ⅳ型超敏反应。血清病（D错）属于Ⅲ型超敏反应。